痰热内结，症见咳嗽痰黄，胸闷痞满，小便短赤，舌质红，苔黄腻，脉滑数者，治宜选用
A. 温胆汤
B. 清气化痰丸
C. 茯苓丸
D. 半夏白术天麻汤
E. 小陷胸汤

正确答案：B。清气化痰丸

解析：本证乃因痰阻气滞，气郁化火，痰热互结所致。热淫于内，灼津成痰，痰热互结，肺失清肃，故咳嗽痰黄；痰热内结，气机阻滞，则胸膈痞闷；小便短赤，舌质红，苔黄腻，脉滑数，亦为痰热之象。故治以清热化痰，理气止咳之法，用清气化痰丸治疗（B对）。温胆汤（A错）的功用为理气化痰，清胆和胃，主治胆胃不和，痰热内扰证。茯苓丸（C错）的功用为燥湿行气，软坚化痰，主治痰伏中脘，流注经络证。半夏白术天麻汤（D错）的功用为化痰息风，健脾祛湿，主治风痰上扰证。陷胸汤（E错）有清热化痰，宽胸散结之功效，主治痰火水饮内结，胸腹胀痛，食饮不消，大便不通。